执业药师资格考试机构是
A. 国家药品监督管理部门
B. 国家人事部
C. 国家药品监督管理部门和人事部
D. 省药品监督管理部门
E. 省人事部门

正确答案：C。国家药品监督管理部门和人事部

解析：本题考查执业药师。执业药师资格考试机构是国家药品监督管理部门和人事部（C对）。在执业药师职业资格考试职责分工方面，国家药品监督管理局主要负责组织拟定考试科目和考试大纲、建立试题库、组织命审题工作，提出考试合格标准建议。人力资源社会保障部负责组织审定考试科目、考试大纲，会同国家药品监督管理局对考试工作进行监督、指导并确定合格标准。国家药品监督管理局（A错）为全国执业药师资格注册管理机构。各省、自治区、直辖市药品监督管理局（D错）为注册机构。